患者，女，43岁，1年前因子宫腺肌症行“全子宫切除术”，最近2个月出现间断潮热、出汗、心悸、失眠等绝经综合征表现。否认高血压、糖尿病及血栓栓塞性疾病史。宜选用的MHT方案是
A. 雌、孕激素连续联合方案
B. 单纯孕激素补充方案
C. 单纯雄激素补充方案
D. 单纯雌激素补充方案
E. 雌、孕激素序贯方案

正确答案：D。单纯雌激素补充方案

解析：本题考查绝经激素治疗（MHT）的常用治疗方案。单雌激素补充方案（D对）适用于子宫已切除的妇女，通常连续应用。